太阳病的头痛特点是
A. 两侧头痛
B. 头痛如裹
C. 头顶胀痛
D. 头项强痛
E. 前额刺痛

正确答案：D。头项强痛

解析：太阳为六经藩篱，统摄营卫，主一身之表，故外邪侵袭人体，太阳首当其冲。邪袭太阳，正气奋起抗邪，正邪交争于表，即为太阳病。脉浮，为外邪侵袭，卫气浮盛于表，向外抗邪在脉象上的反映。由于太阳经脉上额交巅，还出别下项，太阳受邪，经气运行受阻，故见头项强痛（D对）。外邪束表，卫气被遏，不能正常发挥“温分肉”功能，故见恶寒。恶寒为贯穿太阳病始终的一个主症，前人有“有一分恶寒，即有一分表证”之说，虽非绝对，但道出了恶寒在太阳病中的重要地位。